消化性溃疡急性穿孔的典型体征是
A. 腹式呼吸基本消失
B. 腹部压痛最显著的部位
C. 腹肌强直呈板样
D. 右下腹柔软无压痛
E. 腹胀、肠鸣音消失

正确答案：C。腹肌强直呈板样

解析：腹肌强直呈板样（C对）为高度肌紧张表现为“板状腹”，为消化性溃疡急性穿孔的典型体征，见于胃肠穿孔，因穿孔后胃肠内容物流入腹腔产生强烈的化学刺激，使腹壁肌肉高度紧张、强直呈板样。腹式呼吸基本消失（A错）不具有特异性，也可见于膈肌麻痹。腹部压痛最显著的部位（B错）为弥漫性腹膜炎病因的判断依据。腹胀、肠鸣音消失（E错）常为肠麻痹的表现。右下腹柔软无压痛（D错）为阴性体征，可降低考虑急性阑尾炎的可能性。